主要治疗室上性心律失常的药物有
A. 苯妥英钠
B. 利多卡因
C. 维拉帕米
D. 普萘洛尔
E. 美西律

正确答案：C、D。维拉帕米；普萘洛尔

解析：本题考查治疗室上性心率失常的药物。维拉帕米（C对）为钙通道阻断剂，是阵发性室上性心律失常的首选药。普萘洛尔（D对）为β受体阻断剂，用于治疗阵发性室上性心动过速。苯妥英钠（A错）、利多卡因（B错）、美西律（E错）均为Ⅰb类抗心律失常药，仅用于室性心律失常。